患者，女，27岁，已婚。产后恶露1个月未止，量多、色淡、无臭味，小腹空坠，神倦懒言，舌淡，脉缓弱。治疗应首选
A. 举元煎
B. 固本止崩汤
C. 生化汤
D. 八珍汤
E. 补中益气汤

正确答案：E。补中益气汤

解析：患者产后恶露一月未止，量多，色淡，小腹空坠，神倦懒言，舌淡，脉缓弱为气虚证的表现，治疗时要补气摄血固冲，选用补中益气汤（E对）。举元煎功效补气摄血固冲，原方治疗气虚下陷，血崩气脱，亡阳垂危等证，本方实为补中益气汤的缩方，补气力专，多用于气虚较甚之征，且方中无滋阴养血之当归，用于月经过多气虚证（A错）。固本止崩汤补气摄血，固冲止崩，原方治疗气虚血崩昏暗，多用于经血暴下不止，或淋漓日久不尽并伴有气虚症状的崩漏脾虚证（B错）。生化汤功效活血化瘀止血，可用于产后恶露过多，小腹疼痛拒按，舌紫黯或边有瘀点的瘀血证（C错）。八珍汤功效益气补血，治疗面色苍白或萎黄，头晕目眩，四肢倦怠，气短懒言，心悸怔忡，饮食减少，舌淡苔薄白，脉细弱或虚大无力的气血两虚证（D错）。